黄连抗菌作用的主要有效成分是
A. 番泻苷A
B. 阿魏酸
C. 小檗碱
D. 单宁酸
E. 大黄素

正确答案：C。小檗碱

解析：本题考查的是黄连生物碱的活性成分。黄连抗菌作用的主要有效成分是小檗碱（C对）。黄连的有效成分主要是生物碱，已经分离出来的生物碱有小檗碱（含量最高）、巴马汀、黄连碱、甲基黄连碱、药根碱和木兰碱（属于阿朴菲型）等；大多属苄基异喹啉类衍生物，季铵型生物碱。《中国药典》以小檗碱为指标成分进行含量测定。以盐酸小檗碱计，要求味连含小檗碱不得少于5.5%，表小檗碱不得少于0.80%，黄连碱不得少于1.6%，巴马汀不得少于1.5%；要求雅连含小檗碱不得少于4.5%；要求云连含小檗碱不得少于7.0%。黄连的药理作用：（1）抗菌、抗病毒：黄连的抗菌谱广，对革兰阳性和革兰阴性、结核杆菌、真菌等均有抑制或杀灭作用。黄连对钩端螺旋体、幽门螺杆菌也有抑制作用。黄连的抗菌有效成分主要是小檗碱。黄连制剂、小檗碱对各型流感病毒均有抑制作用。（2）抗毒素、抗腹泻：黄连、小檗碱能提高机体对多种细菌毒素的耐受力，从而改善毒血症状。黄连对细菌内毒素所致大鼠死亡有保护作用，小檗碱能对抗蓖麻油、番泻叶等所致的小鼠腹泻，也能对抗霍乱弧菌毒素和大肠杆菌毒素所致的严重腹泻。（3）解热、抗炎：黄连及小檗碱对多种致热物质如牛奶、酵母引起的动物发热有解热作用。黄连的甲醇提取物能对抗多种实验性大鼠足肿胀和肉芽肿，局部用药也能减轻肉芽肿的发展。小檗碱对多种实验性炎症早期渗出、水肿和晚期肉芽增生都有明显的抑制作用。（4）降血糖：黄连煎剂及小檗碱能降低肾上腺素、四氧嘧啶和自发性糖尿病动物的血糖水平，并改善葡萄糖耐量。番泻苷A（A错）、单宁（D错）、大黄素（E错）为大黄的化学成分。从大黄中分离得到蒽醌、二蒽酮、芪、苯丁酮、单宁、萘色酮等不同种类的80多种化合物，大体上可分为蒽醌类、多糖类与鞣质类。其中蒽醌类及其衍生物含量为3%～5%，分为游离型与结合型。《中国药典》以总蒽醌和游离蒽醌为指标成分，采用高效液相色谱法测定药材和饮片中芦荟大黄素、大黄酸、大黄素、大黄酚和大黄素甲醚等总蒽醌的含量，要求药材总蒽醌不得少于1.5%，游离蒽醌不得少于0.20%。大黄有泻下、抗菌、抗炎、止血等药理作用。阿魏酸（B错）为当归含量测定的指标成分。当归有机酚酸的化学结构：当归中主要含有机酸类成分、挥发油和多糖类成分。有机酸类成分主要包括阿魏酸、香草酸、烟酸和琥珀酸等。《中国药典》以阿魏酸和挥发油为指标成分进行含量测定，要求阿魏酸含量不得少于0.050%，挥发油含量不得少于0.4%（ml/g）。阿魏酸时当归抗心肌缺血的有效成分。